可摘局部义齿基托不具备的功能是
A. 承担和集中（牙合）力
B. 保护黏膜及牙槽骨
C. 连接义齿各部成一整体
D. 增强义齿的固位和稳定
E. 修复缺损的软、硬组织

正确答案：A。承担和集中（牙合）力

解析：本题考查可摘局部义齿基托的功能。基托可以承担、传递与分散人工牙的咬合力，而不是集中（牙合）力（A错，为本题的正确答案）。基托是可摘局部义齿的主要组成部分之一。可摘局部义齿的基托可以保护黏膜及牙槽骨（B对），减缓牙槽骨的吸收。基托还有连接功能，连接义齿各部成一整体（C对）并且可增强义齿的固位和稳定（D对）。基托有时可修复缺损的软、硬组织（E对）。此外，基托可以承担、传递与分散人工牙的咬合力。